7793-2010年）规定，教室课桌面的平均照度不应低于
A. 100lx
B. 120lx
C. 150lx
D. 200lx
E. 300lx

正确答案：E。300lx